职业病诊断应当由以下哪类机构承担
A. 省级以上人民政府卫生行政部门批准的医疗卫生机构
B. 县级以上人民政府卫生行政部门批准的医疗卫生机构
C. 省级以上人民政府卫生行政部门指定的医疗卫生机构
D. 县级以上人民政府卫生行政部门指定的医疗卫生机构
E. 省级以上人民政府卫生行政部门批准的卫生防疫机构

正确答案：A。省级以上人民政府卫生行政部门批准的医疗卫生机构